H₁受体阻滞剂的临床应用不包括
A. 过敏性支气管哮喘的预防性治疗
B. 晕动症
C. 荨麻疹
D. 过敏性鼻炎
E. 过敏性休克

正确答案：E。过敏性休克

解析：常用H₁受体阻断药的应用：晕动症、支气管哮喘、鼻炎、偏头痛、焦虑、慢性特发性荨麻疹。H₁受体阻断药品种较多，药理作用和临床应用相似，有第一代和第二代之分。前者有镇静催眠作用，后者多数作用持久，因不易通过血脑屏障，故中枢作用较弱或无（E错，为本题正确答案）。